伤寒病人第二次菌血症发生在
A. 潜伏期
B. 初期
C. 极期
D. 缓解期
E. 极期或缓解期

正确答案：B。初期

解析：伤寒杆菌随血流进入肝、脾、胆囊、肾和骨髓后继续大量繁殖，再次进入血流，引起第二次严重菌血症，并释放强烈的内毒素，产生发热、全身不适等临床症状，出现皮肤玫瑰疹和肝、脾大等，此相当于病程的初期（B对）。伤寒患者第一次菌血症时，病人并无症状，即处于潜伏期（A错）。极期（C错）表现为持续菌血症，缓解期（DE错）大量的伤寒沙门菌随胆汁排入肠道，一部分随肠道排出体外，一部分再次侵入肠道淋巴结。